在队列研究中，失访率一般不应超过
A. 0.05
B. 0.1
C. 0.15
D. 0.2
E. 0.25

正确答案：D。0.2

解析：本题考查队列研究的失访率。队列研究的失访率一般不超过20%（D对ABCE错）。